大青叶除清热解毒外，又能
A. 截疟
B. 止痒
C. 利咽
D. 活血
E. 利湿

正确答案：C。利咽

解析：本题考查大青叶的功效。大青叶除清热解毒外，又能利咽（C对）。大青叶【功效】清热解毒，凉血消斑，利咽消肿。鸦胆子【功效】清热解毒，燥湿杀虫，止痢截疟（A错），腐蚀赘疣。荆芥【功效】散风解表，透疹止痒（B错），止血。紫草【功效】凉血活血（D错），解毒透疹。蒲公英【功效】清热解毒，消痈散结，利湿（E错）通淋。